以下哪一项不是病例对照研究的优点
A. 适用于研究罕见病
B. 可在一次调查中调查多个危险因素
C. 不需大样本
D. 可计算疾病的发病率
E. 可从所获得的资料很快得出结论

正确答案：D。可计算疾病的发病率